小腿部皮肤突然鲜红成片，色如涂丹，边缘清楚，灼热肿胀者，称为
A. 抱头火丹
B. 麻疹
C. 流火
D. 瘾疹
E. 赤游丹

正确答案：C。流火

解析：丹毒发于头面者，名“抱头火丹”（A错）；发于小腿、足部者名“流火”（C对）；发于全身，游走不定者，名“赤游丹”（E错）。麻疹是感受麻疹时邪（麻疹病毒）引起的一种急性出疹性传染病，临床以发热恶寒，咳嗽咽痛，鼻塞流涕，泪水汪汪，畏光羞明，口腔两颊近臼齿处可见麻疹黏膜斑，周身皮肤按序布发麻粒样大小的红色斑丘瘆，皮疹消退时皮肤有糠麸样脱屑和色素沉着斑等为特征（B错）。瘾疹是一种皮肤出现红色或苍白色风团，时隐时现的瘙痒性、过敏性皮肤病，相当于西医的荨麻疹，其特点是：皮肤上出现瘙痒性风团，发无定处，骤起骤退，退后不留痕迹（D错）。